慢性肝病患者，血氨升高导致肝性脑病发生的机制，是干扰了大脑的
A. 蛋白质代谢
B. 脂肪代谢
C. 微量元素代谢
D. 水盐代谢
E. 能量代谢

正确答案：E。能量代谢

解析：慢性肝病患者血氨增高，血氨可以透过血脑屏障进入脑组织，产生神经系统毒性。大脑对氨的去毒作用是通过与α-酮戊二酸结合成谷氨酸，谷氨酸与氨结合成谷氨酰胺，在大量ATP供能的条件下，消耗大量的辅酶等重要代谢物质而实现的。三羧酸循环的重要中间产物α-酮戊二酸大量消耗，将使脑细胞能量供给不足，干扰了大脑的能量代谢（E对），导致了肝性脑病的发生。肝性脑病患者血氨升高对蛋白质代谢（A错）、脂肪代谢（B错）、微量元素代谢（C错）、水盐代谢（D错）影响较小。